女，65岁。间歇全程肉眼血尿2个月，尿呈洗肉水样。无尿频、尿急、尿痛。间断出现，近日血尿加重。配偶吸烟。最可能的疾病是
A. 膀胱癌
B. 膀胱炎
C. 肾盂肾炎
D. 尿路结石
E. 肾癌

正确答案：A。膀胱癌

解析：老年患者（膀胱癌的好发人群），间歇全程肉眼血尿（膀胱癌的典型临床表现）2个月，近日加重，无尿频、尿急、尿痛，最可能的诊断为膀胱癌（A对），膀胱癌是泌尿系统最常见的肿瘤，血尿是膀胱癌最常见的症状，主要表现为间歇性无痛全程肉眼血尿，可自行减轻或停止。膀胱炎（B错）多见于中青年患者，主要表现为发热、尿频、尿急、尿痛、尿不尽感，血尿主要为终末血尿。肾盂肾炎（C错）主要表现为发热、腰痛、尿频、尿急、尿痛、血尿。尿路结石（D错）主要症状为疼痛和血尿，该患者没有疼痛。肾癌（E错）主要表现为肉眼血尿，肾区疼痛及腹部肿块。